TAT是一种
A. 明尼苏达多项调查表
B. 卡特尔人格因素问卷
C. 艾森克人格问卷
D. 洛夏墨迹测试
E. 主题统觉试验

正确答案：E。主题统觉试验

解析：主题统觉测验，简称TAT（E对），是在国内比较常见的投射法人格测验，它是由H.A. 默里于1935年为性格研究而编制的一种测量工具。全套测验共有30张内容隐晦的黑白图片，另有空白卡片一张，图片的内容以人物或景物为主。每张图片都标有字母号，按照年龄、性别把图片组合成四套测验，每套20张，分成两个系列，每系列各有10张。分别用于男人、女人、男孩和女孩，其中有些照片是共用的。测验进行时，主测者按顺序逐一出示图片，要求被测者对每一张图片都根据自己的想象和体验，讲述一个内容生动、丰富的故事。